患者，女，29岁。妊娠53天，呕吐剧烈，吐出物带血丝，消瘦明显，嘴唇燥裂，口渴，大便干燥，皮肤弹性差，精神委靡，舌红，苔花剥，脉细滑无力。其中医证型是
A. 脾胃虚弱型
B. 肝胃不和型
C. 痰湿阻滞型
D. 气阴两亏型
E. 阴虚火旺型

正确答案：D。气阴两亏型

解析：患者妊娠53天，呕吐剧烈，伤气，伤阴，饮食难进若不能及时纠正，可致精气耗散，正气受损，出现气阴两伤，表现为消瘦明显，嘴唇燥裂，口渴，大便干燥，皮肤弹性差，精神委靡，舌红，苔花剥，脉细滑无力属气阴两亏证（D对）。口淡、呕吐物为清水或食物者，多为脾胃虚弱（A错）。肝胃不和证证候∶妊娠早期，恶心呕吐，甚则食入即吐，呕吐酸水或苦水，口苦咽干，头晕而胀，胸胁胀痛。舌质红苔薄黄或黄，脉弦滑数（B错）。脾虚痰湿证证候∶妊娠早期，恶心呕吐，甚则食入即吐，口淡，吐出物为清水或食物，头晕，神疲倦怠，嗜睡。舌淡苔白，脉缓滑无力（C错）。口燥咽干、失眠多梦、颧红目赤、潮热盗汗、五心烦热等阴虚火旺证（E错）。